消风止痒颗粒除消风止痒外，又能
A. 活血化瘀
B. 清热凉血
C. 散结消肿
D. 凉血利湿
E. 清热除湿

正确答案：E。清热除湿

解析：本题考查的是消风止痒颗粒的功能。消风止痒颗粒除消风止痒外，又能清热除湿（E对）。消风止痒颗粒：【功能】清热除湿，消风止痒。当归苦参丸：【功能】活血化瘀（A错），燥湿清热。消银颗粒：【功能】清热凉血（B错），养血润肤，祛风止痒。小金丸：【功能】散结消肿（C错），化瘀止痛。北刘寄奴：【功效】活血祛瘀，通经止痛，凉血止血，清热利湿（D错）。